目前临床中最常用的种植体材料是
A. 经基磷灰石
B. 生物陶瓷
C. 金属钛
D. 高分子材料
E. 氧化铝

正确答案：C。金属钛

解析：本题考查种植体的常用材料。目前临床中最常用的种植体材料是金属钛（C对）。纯钛具有良好的理化性能和生物相容性，比重轻、强度高、无磁性、收缩性小，屈服强度和疲劳强度均高，且由于钛表面坚固的氧化层使钛钝化，具备了非金属的特性，能与有生命的骨组织形成化学性结合的骨结合界面，保证了种植体在骨组织内的长期存留。